氨苄西林或阿莫西林的注射溶液，不能和磷酸盐类药物配伍使用，是因为
A. 发生β-内酰胺开环，生成青霉酸
B. 发生β-内酰胺开环，生成青霉醛酸
C. 发生β-内酰胺开环，生成青霉醛
D. 发生β-酰胺开环，生成2，5-吡嗪二酮
E. 发生β-内酰胺开环，生成聚合产物

正确答案：D。发生β-酰胺开环，生成2，5-吡嗪二酮

解析：本题考查β-内酰胺类抗菌药物。氨苄西林和阿莫西林水溶液中若含有磷酸盐、山梨醇、硫酸锌、二乙醇胺等时，会发生分子内成环反应，生成2，5-吡嗪二酮（D对）。发生β-内酰胺开环，才会生成生成青霉酸（A错）、青霉醛酸（B错）、青霉醛（C错）、聚合产物（E错）。